心室肌细胞不具有哪种生理特性
A. 兴奋性
B. 自律性
C. 传导性
D. 收缩性
E. 有效不应期长

正确答案：B。自律性